医疗审慎的积极作用的突出表现应该是
A. 有利于保护医生的利益
B. 有利于保护医院的利益
C. 有利于医疗质量的提高
D. 有利于保护医学的发展
E. 有利于保护医际的和谐

正确答案：C。有利于医疗质量的提高